以下关于共同参与型医患关系的描述中，正确的是
A. 医生是主动的，处权威地位，病人完全按医生的要求去做
B. 医生是主角，病人是配角
C. 患者在医师指导下自己治疗
D. 医生的作用占优势，同时有限度地调动病人的主动性
E. 医生病人都是主动积极参与者

正确答案：E。医生病人都是主动积极参与者

解析：共同参与型这是一种双向性的，以生物心理社会医学模式为指导思想的医患关系，其特征是“医生帮助病人自我恢复”，医患双方的关系建立在平等基础上，双方有近似相等的权利和地位，共同参与医疗决策和实施过程，相互尊重、相互依赖。这种模式主要适用于慢性疾病的治疗，因为这些病人自身的经验常常为治疗提供了重要的线索，即所谓“久病成良医”，而医生只起一种指导性的辅助作用，帮助病人自我治疗。在这种医患关系模式中，病人的主观能动性得到充分的发挥，尤其是医患双方在知识水平、受教育的程度和生活阅历上越接近，这种医患关系模式就越适合。掌握“医患沟通的理论、技术与其应用以及医患关系模式”知识点。